幻觉是指
A. 感觉器官在梦幻中的一种知觉体验
B. 人脑的一种丰富想象的思维过程
C. 感觉器官缺乏客观刺激时的知觉体验
D. 人脑对客观事物的一种错误猜想
E. 感觉器官对客观事物的错误知觉体验

正确答案：C。感觉器官缺乏客观刺激时的知觉体验

解析：幻觉是指没有现实刺激作用于感觉器官时出现的知觉体验（C对），是一种虚幻的知觉。